参与联合脱氨基的是
A. 转氨酶
B. 乳酸脱氢酶
C. HMG-CoA还原酶
D. 丙酮酸羧化酶
E. 琥珀酸CoA羧化酶

正确答案：A。转氨酶

解析：转氨基作用与谷氨酸脱氢作用的结合称为联合脱氨基作用。转氨基作用是α-氨基酸在转氨酶（A对）的作用下与α-酮戊二酸反应生成谷氨酸；脱氨基作用是L-谷氨酸在L-谷氨酸脱氢酶的作用下脱下氨基生成α-酮戊二酸。乳酸脱氢酶（B错）催化的是丙酮酸转变为乳酸的反应，HMG-CoA还原酶（C错）是胆固醇合成的关键酶，丙酮酸羧化酶（D错）催化的是丙酮酸生成草酰乙酸。